粉末中含钟乳体细胞甚多的药材是
A. 益母草
B. 薄荷
C. 荆芥
D. 金钱草
E. 穿心莲

正确答案：E。穿心莲

解析：本题考查的是穿心莲的显微鉴别。粉末中含钟乳体细胞甚多的药材是穿心莲（E对）。穿心莲【显微鉴别】粉末上下表皮均有增大的晶细胞，内含大型螺状钟乳体，较大端有脐样点痕，层纹波状。下表皮气孔直轴式，副卫细胞大小悬殊，少数为不定式。另有腺鳞和非腺毛。益母草（A错）【显微鉴别】茎横切面：①表皮细胞外被角质层，有毛茸；腺鳞头部4、6或8细胞，柄单细胞。②皮层为数列薄壁细胞。③内皮层明显。中柱鞘纤维束微木化。④韧皮部较窄。⑤木质部在棱角处较发达。⑥髓部薄壁细胞较大。⑦薄壁细胞含细小草酸钙针晶及小方晶。薄荷（B错）【显微鉴别】叶表面制片或粉末：①腺鳞的腺头呈扁圆球形，由8个分泌细胞排列成辐射状。②表皮细胞壁薄，呈微波状，上、下表皮有直轴式气孔，以下表皮为多。③小腺毛为单细胞头，单细胞柄。荆芥（C错）【显微鉴别】粉末：黄棕色。①宿萼表皮细胞垂周壁深波状弯曲。②腺鳞头部8细胞，柄单细胞，棕黄色。③小腺毛头部1～2细胞，柄单细胞。④非腺毛由1～6细胞组成，大多具壁疣。⑤叶表皮淡黄绿色，壁薄，类多角形，有气孔及毛茸。金钱草（D错）【显微鉴别】茎横切面：①表皮细胞外被角质层，有时可见腺毛，头部单细胞，柄1～2细胞。②栓内层宽广，细胞中有的含红棕色分泌物③中柱鞘部位纤维断续排列成环，壁微木化。④形成层不明显。⑤薄壁细胞含淀粉粒。